抽样调查
A. 为了早期发现、早期诊断、早期治疗宫颈癌
B. 为了调查大学生乙型肝炎感染情况，可不必调查所有大学的全部学生
C. 一项在健康人中发现可疑的肺结核患者的调查
D. 对个别发生的麻疹病人进行调查
E. 一次因会餐引起的食物中毒调查

正确答案：B。为了调查大学生乙型肝炎感染情况，可不必调查所有大学的全部学生

解析：本题考查抽样调查的概念。抽样调查是指通过随机抽样的方法，对特定时点、特定范围内人群的一个代表性样本进行调查，以样本的统计量来估计总体参数所在范围，即通过对样本中的研究对象的调查研究来推论其所在总体的情况。题中调查选取部分大学生调查乙肝感染情况（B对ACDE错），属于抽样调查的研究方法。